有利于食品腐败变质的条件是
A. 高渗环境
B. 低渗环境
C. 寒冷环境
D. Aw值大于0.9
E. 食品外观完好无损

正确答案：D。Aw值大于0.9

解析：本题考查有利于食品腐败变质的条件。食品腐败变质是以食品本身的组成和性质为基础，在环境因素影响下，主要由微生物的作用引起；是食品本身、环境因素和微生物三者互为条件、相互影响、综合作用的结果。如Aw＞0.9（D对ABCE错）有利于细菌生长。